公共场所从业人员患病在治愈前不得从事直接为顾客服务工作，这类疾病不包括
A. 甲型病毒性肝炎
B. 细菌性痢疾
C. 伤寒
D. 活动性肺结核
E. 军团病

正确答案：E。军团病

解析：本题考查公共场所从业人员的健康检查制度。公共场所的经营者应负责组织本单位从业人员的健康检查工作，获得有效健康证方可上岗，患有甲型病毒性肝炎（A对）、戊型病毒性肝炎、细菌性痢疾（B对）、伤寒（C对）、活动性肺结核（D对）、化脓性或渗出性皮肤病等疾病的从业人员，在治愈前不得从事直接为顾客服务的工作。军团病（E错，为本题正确答案）不在这类疾病范围内。